某男，19岁。患慢性肾炎8年，日前突发眼睑浮肿，遂来就诊。刻下恶寒、发热、无汗、肢体酸楚、不欲饮水、脉浮滑。医师诊断为风水水肿，治当宣肺利水。处方：麻黄9g，苦杏仁10g，防风6g，浮萍10g，茯苓10g，泽泻10g，车前子15g（包煎），紫苏叶6g（后下）。上述处方中能宣肺利水的药是
A. 麻黄
B. 防风
C. 泽泻
D. 茯苓
E. 紫苏叶

正确答案：A。麻黄

解析：本题考查麻黄的功效。上述处方中能宣肺利水的药是麻黄（A对）。麻黄【功效】发汗解表，宣肺平喘，利水消肿。防风（B错）【功效】祛风解表，胜湿，止痛，解痉。泽泻（C错）【功效】利水渗湿，泄热。茯苓（D错）【功效】利水渗湿，健脾，安神。紫苏叶（E错）【功效】解表散寒，行气和胃。